关于因果联系的叙述，下列哪项是错误的
A. 无剂量反应关系表明不存在因果联系
B. 联系的强度越大，存在因果联系的可能性越大
C. 联系的一致性好，说明存在因果联系的可能性大
D. 先因后果是判断因果联系的必要条件
E. 联系的合理性好，表明存在因果联系的可能性大

正确答案：A。无剂量反应关系表明不存在因果联系

解析：本题考查因果联系推断。剂量-反应关系的存在进一步支持因果关系的存在，无剂量反应关系并不能表明不存在因果联系（A错，为本题正确答案）。先因后果是判断因果联系的必要条件（D对）。联系的强度越大（B对），说明存在因果联系的可能性越大。联系的一致性好（C对），合理性好（E对），也能表明存在因果联系的可能性大。